既散外风又息内风的药有
A. 地龙
B. 防风
C. 天麻
D. 蒺藜
E. 僵蚕

正确答案：B、C、E。防风；天麻；僵蚕

解析：本题考查的是防风、天麻与僵蚕的性能特点。既散外风又息内风的药有防风（B对）、天麻（C对）与僵蚕（E对）。防风：【性能特点】本品辛微温发散，甘缓不峻，生用、炒炭性能有别。生用辛散甘缓，微温力缓，入膀胱、脾经，散外风、胜湿邪而发表止痛；入肝经，祛内风而止痉。治风通用药，散外风、息内风皆宜，治风寒、风热及表证夹湿皆可，风寒湿三邪客体用之最宜。炒炭，涩多散少，敛兼升散，入脾、肝经而长于止血、止泻，治崩漏下血及泄泻宜用。天麻：【性能特点】本品甘缓质重，柔润不燥，性平不偏，专归于肝。善息风止痉、平抑肝阳，治肝阳、肝风诸证，无论寒热虚实皆宜。能祛风通络，治痹痛肢麻与手足不遂。僵蚕：【性能特点】本品辛发散，咸软坚，平而偏凉，入肝、肺经。既善息风化痰止痉，治肝风或痰热之惊痫抽搐；又能祛风而止痛、止痒，治风热或肝热之头痛目赤、咽痛及风疹瘙痒；还能化痰散结消肿，治瘰疬痰核、痄腮。地龙（A错）：【性能特点】本品咸寒清泄，走窜通利。入肝经，能清热息风而止痉；入肺经，能清肺泄热而平喘；走经络，能通络治痹；入膀胱经，能利尿通闭。蒺藜（D错）：【性能特点】本品苦泄辛散，平而偏凉，有小毒，力较强，专入肝经。既善平抑肝阳、疏泄肝郁，治阳亢眩晕、肝郁胁痛；又善祛风明目、散风止痒，治风热目赤、风疹瘙痒。